生存分析中的结果变量是
A. 生存时间
B. 是否删失
C. 生存结局
D. 生存时间与生存结局

正确答案：D。生存时间与生存结局

解析：本题考查结果变量。生存分析中的结果变量是生存时间与生存结局（D对ABCE错）。